动态作业的特点是
A. 能量消耗水平高
B. 易疲劳
C. 能量消耗水平不高
D. 不易疲劳
E. 能量消耗水平高，不易疲劳

正确答案：E。能量消耗水平高，不易疲劳